首选用于治疗乳腺纤维瘤肝郁痰凝证的方剂是
A. 柴胡疏肝散
B. 丹栀逍遥散
C. 二陈汤加减
D. 逍遥散合二陈汤
E. 逍遥散合香贝养荣汤

正确答案：D。逍遥散合二陈汤

解析：乳腺纤维腺瘤相当于中医的乳核。中医治疗乳核肝郁痰凝证，治宜疏肝解郁、化痰散结，方药当选用逍遥散疏肝解郁，合二陈汤化痰（D对）。柴胡疏肝散（A错）疏肝理气，活血止痛。丹栀逍遥散（B错）清肝解郁，养血健脾。二陈汤（C错）燥湿化痰，理气和中。香贝养荣汤（E错）治上石疽属气血两虚者。